分子中存在羧酸酯结构，具有起效快、维持时间短的特点，适合诱导和维持全身麻醉期间止痛，以及插管和手术切口止痛。该药物是
A. 芬太尼
B. 美沙酮
C. 舒芬太尼
D. 阿芬太尼
E. 瑞芬太尼

正确答案：E。瑞芬太尼

解析：本题考查瑞芬太尼。分子中存在羧酸酯结构，具有起效快、维持时间短的特点，适合诱导和维持全身麻醉期间止痛，以及插管和手术切口止痛的药物是瑞芬太尼（E对）。在4-苯基哌啶类结构中，哌啶环的4位引入苯氨基，并在苯基氨基的氮原子上丙酰化得到4-苯氨基哌啶类构的强效镇痛药，代表药物是枸橼酸芬太尼（A错），亲脂性高，易于通过血-脑屏障，起效快，作用强，镇痛作用为哌替啶的500倍，吗啡的80～100倍。作用时间短，仅持续1～2小时，这源于芬太尼脂溶性大，在体内迅速再分布造成药物浓度下降。进一步的结构优化，将芬太尼哌啶环的4位碳原子由叔碳改为季碳原子后，开发了一系列芬太尼类药物，将哌啶环中的苯基以极性乙基四氮唑取代得到阿芬太尼（D错），因为其pK（6.5）较低，在生理条件下，更易透过血-脑屏障。将哌啶环中的苯基以噻吩替代，得到舒芬太尼（C错），镇痛作用强，安全性好，治疗指数高，作用发生快，持续时间短，临床用于辅助麻醉的药物。将哌啶环中的苯基以羧酸酯替代得到属于前体药物的瑞芬太尼。具有起效快，维持时间短，临床用于诱导和维持全身麻醉期间止痛、插管和手术切口止痛。芬太尼、美沙酮（B错）、舒芬太尼、阿芬太尼结构中均无羧酸酯。